有关中枢神经传导通路和间脑特异性中继核团，正确的是
A. 腹后内侧核接受三叉丘系和孤束核发出的味觉纤维
B. 内侧膝状体接受听觉纤维
C. 外侧膝状体接受视觉纤维
D. 丘脑腹后外侧核接受内侧丘系、脊髓丘系
E. 以上均正确

正确答案：E。以上均正确

解析：腹后内侧核接受三叉丘系和孤束核发出的味觉纤维（A对），内侧膝状体接受听觉纤维（B对），外侧膝状体接受视觉纤维（C对），丘脑腹后外侧核接受内侧丘系、脊髓丘系（D对，E为本题正确答案）。头面部痛温觉和触压觉传导通路第3级神经元的胞体在背侧丘脑的腹后内侧核。